以下有关恒牙髓腔的应用解剖叙述中，不正确的是
A. 下颌切牙因根管较小，根管侧壁，厚约1mm，根管治疗时应防止侧穿根管壁
B. 上颌前磨牙颊侧髓角较高，补牙备洞时应避免穿通颊侧髓角
C. 上颌前磨牙因髓室底较深，开髓时勿将暴露的髓角误认为是根管口
D. 下颌磨牙牙冠向舌侧倾斜，应在（牙合）面正中央处开髓，尤其是偏向舌侧，可避免舌侧薄弱而折断
E. 下颌第一磨牙远中舌侧根管细小弯曲，治疗时应加注意

正确答案：D。下颌磨牙牙冠向舌侧倾斜，应在（牙合）面正中央处开髓，尤其是偏向舌侧，可避免舌侧薄弱而折断

解析：本题考查恒牙髓腔的应用解剖。下颌磨牙牙冠向舌侧倾斜，应在牙合面正中央处开髓，尤其是偏向舌侧，可避免舌侧薄弱而折断（D错，为本题正确答案）不符合恒牙髓腔的应用解剖。下颌磨牙牙冠向舌侧倾斜，髓腔偏向颊侧，故开髓部位应在牙合面偏向颊尖处。若在牙合面中央处开髓，尤其是偏向舌侧，反而易导致舌侧壁薄弱而折断。下颌切牙因根管较小，根管侧壁，厚约1mm，根管治疗时应防止侧穿根管壁（A对）。上颌前磨牙近远中径靠近牙合面宽而近颈部窄，开髓时应注意窝洞的形态和位置，防止从近中面或远中面穿孔。上颌前磨牙颊侧髓角较高，补牙备洞时应避免穿通颊侧髓角（B对）。上颌前磨牙因髓室底较深，开髓时勿将暴露的髓角误认为是根管口（C对）。下颌第一磨牙远中舌侧根管细小弯曲，治疗时应加注意（E对）。